治疗急性血栓栓塞性疾病宜选用
A. 华法林
B. 肝素
C. 噻氯匹定
D. 氨甲苯酸
E. 链激酶

正确答案：E。链激酶

解析：本题考查链激酶。链激酶（E对）为溶栓药，用药后迅速分布全身，可用于急性血栓栓塞。华法林（A错）起效缓慢，持续时间较长。肝素（B错）是一种抗凝剂，用于防治血栓形成或栓塞性疾病。噻氯匹定（C错）用于抑制血小板高聚集性疾病，预防血管手术和体外循环发生的血栓形成以及降低血栓形成中风的危险性。氨甲苯酸（D错）属于抗纤维蛋白溶解药。